丹毒的主要病因病机是
A. 风温夹痰凝结经络
B. 风温湿热蕴结肌肤
C. 外邪侵犯，血分有热，郁于肌肤
D. 经络阻塞，气血凝滞
E. 暑湿热毒流注肌间

正确答案：C。外邪侵犯，血分有热，郁于肌肤

解析：风温夹痰凝结经络的病位在经络，丹毒病位在肌肤（A错）。风温湿热蕴结肌肤，若加之脏腑蕴毒，可形成有头疽（B错）。丹毒为外邪侵犯，血分有热，郁于肌肤而发（C对）。经络阻塞，气血凝滞多形成各种外科疾病的肿块（D错）。暑湿热毒流注肌间可形成流注（E错）。